某疟疾病患者突然出现昏迷，给予二盐酸奎宁静滴抢救，抢救过程中，病人又出现寒战，高热，血红蛋白尿，应改用哪种药物继续抢救
A. 氯喹
B. 甲氟喹
C. 伯氨喹
D. 乙胺嘧啶
E. 青蒿素

正确答案：E。青蒿素

解析：题目中的患者处在疟疾的红细胞内期，可出现引起寒战、高热、出汗等疟疾的临床症状，但是在奎宁治疗以后出现此症状的为恶性疟。而青蒿素主要治疗对耐氯喹或多药耐药的恶性疟。而且可以透过血脑屏障，对脑性虐的抢救有较好的效果。掌握“氯喹、青蒿素、伯氨喹及乙胺嘧啶”知识点。